空、回肠在腹腔主要占据部位，正确的是
A. 空肠在右上部
B. 回肠在左上部
C. 空肠在左下部
D. 回肠在右上部
E. 回肠在右下部

正确答案：E。回肠在右下部

解析：空肠一般在脐区和左腰区，而回肠一般在脐区、右腹股沟区和盆腔，相对来说空肠在左上方而回肠在右下部(E对)。